慢性汞中毒震颤的特征是
A. 意向性震颤
B. 阵发性震颜
C. 静止性震额
D. 对称性震颤
E. 癔症性震颤

正确答案：A。意向性震颤